甲药品零售连锁企业，经营范围：化学药、第二类精神药品、中成药、中药饮片、生物制品。甲下辖若干连锁门店，该企业制定的体系文件规定实施统一采购配送、统一质量管理、统一财务管理、统一计算机系统、统一药学服务。乙门店为甲的所属门店，且为医疗保险定点零售药店，经营类别：处方药、甲类非处方药、乙类非处方药；经营范围：化学药、第二类精神药品、中成药、中药饮片。丙药品零售企业（非连锁门店），经营类别：处方药、甲类非处方药、乙类非处方药；经营范围：化学药、中成药、中药饮片。（1）米非司酮片（仅用于紧急避孕）；（2）复方磷酸可待因口服溶液；（3）氨酚曲马多片；（4）氨酚待因片；（5）复方地芬诺酯片；（6）尿通卡克乃其片；（7）氨酚氢可酮片；（8）复方甘草片。上述药品中，乙可以销售，但丙不得销售的有
A. （1）（2）
B. （2）（7）
C. （3）（4）（7）
D. （5）（6）（8）

正确答案：B。（2）（7）

解析：本题考查药品的分类。上述药品中，乙可以销售，但丙不得销售的有（2）（7）（B对）。2015年4月3日，原国家食品药品监管总局、公安部、原国家卫生计生委联合发布了《关于将含可待因复方口服液体制剂列入第二类精神药品管理的公告》（2015年第10号）：“根据《麻醉药品和精神药品管理条例》的有关规定，国家食品药品监管总局、公安部、国家卫生计生委决定将含可待因复方口服液体制剂（包括口服溶液剂、糖浆剂）列入第二类精神药品管理。”公告自2015年5月1日起施行。含可待因复方口服液体制剂品种如下。复方磷酸可待因溶液、复方磷酸可待因溶液（Ⅱ）、复方磷酸可待因口服溶液、复方磷酸可待因口服溶液（Ⅲ）、复方磷酸可待因糖浆、可愈糖浆、愈酚待因口服溶液、愈酚伪麻待因口服溶液。目录确定的我国生产及使用的第二类精神药品有28个品种，具体有以下品种：异戊巴比妥、巴比妥、地西泮、氟西泮、氨酚氢可酮片等。药品零售企业不得经营的药品：麻醉药品、放射性药品、第一类精神药品、终止妊娠药品（包括含有“米非司酮（A错）”成分的所有药品制剂）、蛋白同化制剂、肽类激素（胰岛素除外）、药品类易制毒化学品、疫苗，以及我国法律法规规定的其他禁止零售的药品。部分含特殊药品复方制剂的品种范围：（1）含曲马多口服复方制剂：复方曲马多片、氨酚曲马多片（B错）、氨酚曲马多胶囊。（2）口服固体制剂：阿司待因片、阿司可咖胶囊、阿司匹林可待因片、氨酚待因片、氨酚待因片（Ⅱ）。（3）复方地芬诺酯片。（4）其他含麻醉药品口服复方制剂：复方福尔可定口服溶液、复方福尔可定糖浆、复方枇杷喷托维林颗粒、尿通卡克乃其片。药品购销管理：药品批发企业从药品上市许可持有人、药品生产企业直接购进的复方甘草片、复方地芬诺酯片（D错）等含特殊药品复方制剂，可以将此类药品销售给其他批发企业、零售企业和医疗机构。